男，38岁，肱骨干骨折行手拉法复位，夹板外固定治疗，既往体健，8个月后复查X线片示骨折线存在，断端有0.3cm间隙，断端骨髄腔己封闭硬化，此时应选择的治疗是
A. 中医中药治疗
B. 改为牵引固定
C. 继续夹板固定
D. 手术植骨并内固定
E. 改为石膏外固定

正确答案：D。手术植骨并内固定

解析：患者男，38岁，肱骨干骨折行手拉法复位，夹板外固定治疗，8个月后复查X线片示骨折线存在，断端有0.3cm间隙，断端骨髄腔己封闭硬化，该患者考虑诊断为骨折不愈合，应切除硬化骨，打通骨髓腔，修复骨缺损，行手术植骨并内固定（D对）。中医中药治疗（A错）可作为辅助治疗，但患者断端骨髄腔己封闭硬化，并不能代替手术。骨折的外固定包括夹板固定（C错）、石膏绷带固定（E错）、牵引固定（B错）等，均为骨折的非手术治疗措施，作为辅助性外固定，也不能替代手术。